颞下颌关节侧斜位片上，关节间隙的宽度为
A. 上间隙最宽，前间隙及后间隙等宽
B. 上间隙、前间隙及后间隙宽度相等
C. 上间隙最宽，后间隙次之，前间隙最窄
D. 上间隙最宽，前间隙次之，后间隙最窄
E. 后间隙最宽，上间隙次之，前间隙最窄

正确答案：C。上间隙最宽，后间隙次之，前间隙最窄

解析：本题考查颞下颌关节经颅侧斜位片。正常情况下，关节上间隙较宽，后间隙次之，前间隙狭最窄（C对）。颞下颌关节经颅测斜位片又称为许勒位片。颞下颌关节侧斜位显示关节凹、关节结节、髁状突及关节间隙，此片关节间隙变化能反映出关节盘的病变以及关节盘与髁状突的关系。